湿邪引起的常见症状是
A. 肌肤不仁，关节疼痛重着
B. 周身困重，关节红肿热痛
C. 关节疼痛，游走不定
D. 四肢困倦，心烦口渴
E. 冷厥不仁，肢体屈伸不利

正确答案：A。肌肤不仁，关节疼痛重着

解析：本题考查的是湿邪性质及致病特点。湿邪引起的常见症状是肌肤不仁，关节疼痛重着（A对）。湿邪的性质及致病特点。（1）湿为阴邪，易阻遏气机，损伤阳气：湿邪侵及人体，留滞于脏腑经络，最易阻遏气机，使气机升降失常，经络阻滞不畅，常可出现胸闷脘痞、小便短涩、大便不爽等症状。此外，湿为阴邪，易损伤阳气。脾主运化水湿，其性喜燥而恶湿，故外感湿邪，留滞体内，常先困脾气，使脾阳不振，运化水湿功能减弱，水湿停聚，出现腹泻、尿少、水肿、腹水等病证。（2）湿性重浊：“重”，即沉重或重着之意。感受湿邪，常可见头重如裹、周身困重、四肢酸懒沉重等症状。若湿邪留滞经络关节，则阳气输布受阻，故见肌肤不仁、关节疼痛重着等，又称“湿痹”或“着痹”。“浊”，即秽浊不清，多指分泌物和排泄物秽浊不清而言。临床症状多见面垢眵多、大便溏泻、下利黏液脓血、小便浑浊、妇女白带过多、湿疹浸淫流水等，都是湿邪秽浊的表现。（3）湿性黏滞：“黏”，即黏腻，“滞”，即停滞。湿邪黏腻停滞，主要表现在两个方面：一是指湿邪致病临床表现多黏滞不爽，如排出物及分泌物多滞涩而不畅；二是指湿邪为病多缠绵难愈，病程较长或反复发作。如湿温、湿痹、湿疹等病，皆因湿邪难以祛除而不易速愈。（4）湿性趋下，易伤阴位：湿邪伤人，其病多见于下部，如下肢水肿明显。此外，淋浊、带下、泄利等病证，亦多由湿邪下注所致。周身困重，关节红肿（B错）为湿热引起的常见症状。周身困重由湿邪所致，关节红肿由热邪所致。故周身困重，关节红肿乃湿热引起的常见症状。关节疼痛，游走不定（C错）为风湿引起的常见症状。关节疼痛由湿邪所致，游走不定由风邪所致。故关节疼痛，游走不定乃风湿引起的常见症状。四肢困倦，心烦口渴（D错）为暑湿引起的常见症状。暑多挟湿：夏季气候炎热，且雨水较多，热蒸湿动，空气中湿度增加，故暑邪致病，多挟湿邪，即暑邪湿邪合而致病。其临床表现是除发热、心烦、口渴外，还常兼见四肢困倦、胸闷恶心、大便溏泄或不爽等湿邪致病症状。冷厥不仁，肢体屈伸不利（E错）为寒邪引起的常见症状。寒邪的性质及致病特点。（1）寒为阴邪，易伤阳气：“阴盛则寒”，寒为阴气盛的表现，故其性属阴。又“阴盛则阳病”，感受寒邪，最易损伤人体阳气，阳气受损，温煦气化功能减弱，人体功能活动降低，从而表现为寒证。（2）寒性凝滞，主痛：“凝滞”即凝结、阻滞不通之意。寒邪伤人，阴气偏盛，阳气受损，经脉气血为寒邪凝滞不通，不通则痛。故寒邪伤人多见疼痛症状。例如，偏于寒盛之痹证，则多见疼痛较剧。（3）寒性收引：收引，有收缩牵引之意。寒邪侵袭人体，可使气机收敛，腠理、经络、筋脉收缩而挛急。例如，寒邪侵袭肌表，毛窍腠理闭塞，卫阳被郁不得宣泄，则可见恶寒发热、无汗等；寒客血脉，则气血凝滞，血脉挛缩，可见头身疼痛、脉紧；寒客经络关节，经脉拘急收引，则可使肢体屈伸不利，或冷厥不仁。